男，38岁，间歇性浮肿10余年，伴恶心、呕吐1周。查血红蛋白80g/L，血压20.7/14.7kPa（155/110mmHg），尿蛋白++，颗粒管型2～3个/HP，尿比重1.010～1.012。上例病人还应立即作的检查项目是
A. 24小时尿蛋白定量
B. 乙肝病毒全套
C. 肝功能全套
D. 血肌酐、尿素氮
E. 血胆固醇

正确答案：D。血肌酐、尿素氮

解析：患者初步诊断为慢性肾小球肾炎，应首选血肌酐、尿素氮检查（D对），进一步了解肾功能受损情况。24小时尿蛋白定量（A错）、血胆固醇（E错）主要用于肾病综合征的诊断。乙肝病毒全套（B错）、肝功能全套（C错）主要用于乙型肝炎、肝硬化的诊断。